能与阻遇蛋白结合，使操纵基因开放的是
A. 乳糖
B. 葡萄糖
C. cAMP
D. 色氨酸
E. 阿拉伯糖

正确答案：A。乳糖